阴阳辨证中阴证的表现为
A. 形寒发热
B. 口渴、纳呆
C. 骨蒸潮热、颧红
D. 大便秘结
E. 口燥咽干

正确答案：C。骨蒸潮热、颧红

解析：为了对病情进行更高层面或总的归纳,可以用阴证与阳证概括其他六类证,即表证、热证、实证属阳,里证、寒证、虚证属阴,阴、阳两纲可以统领其他六纲而成为八纲中的总纲。骨蒸潮热、颧红为虚证（C对）。